有关Ⅲ度胎盘早剥的描述，正确的是
A. 阴道流血量与贫血程度呈正比
B. 易导致凝血功能障碍
C. 胎盘剥离面为胎盘面积的1/5
D. 出现无原因无痛性阴道流血
E. 一般胎儿存活

正确答案：B。易导致凝血功能障碍

解析：Ⅲ度胎盘早剥的剥离面超过胎盘面积的1/2（C错），阴道流血较多伴持续性腹痛加剧（D错），且阴道流血量与贫血程度不成正比（A错），触诊胎位不清，听诊胎心消失，胎儿一般不能存活（E错）。Ⅲ度胎盘早剥，从剥离处释放大量组织凝血活酶，激活凝血系统，引发弥散性血管内凝血，随病情进展，继发性引起纤溶亢进，大量凝血因子消耗，易导致凝血功能障碍（B对）。